两药联合应用可产生相加作用的是
A. 异丙肾上腺素与美托洛尔
B. 肝素与鱼精蛋白
C. 苯巴比妥与双香豆素
D. 磺胺甲噁唑与甲氧苄啶
E. 阿替洛尔与氢氯噻嗪

正确答案：E。阿替洛尔与氢氯噻嗪

解析：本题考查药物的协同作用。相加作用是指两药合用的作用是两药单用时的作用之和，如β受体阻断药阿替洛尔与利尿药氢氯噻嗪合用（E对）。